一类与种属无关的存在人、动物和微生物之间的共同抗原是
A. 自身抗原
B. 同种异型抗原
C. 超抗原
D. 独特型抗原
E. 异嗜性抗原

正确答案：E。异嗜性抗原